分子中含有亲脂性长链取代基，为长效β₂受体激动剂药物是
A. 沙丁胺醇
B. 盐酸克仑特罗
C. 盐酸多巴胺
D. 沙美特罗
E. 盐酸多巴酚丁胺

正确答案：D。沙美特罗

解析：本题考查β₂受体激动剂沙美特罗。沙美特罗（D对）为沙丁胺醇的侧链氮原子上的叔丁基用一长链的亲脂性取代基取代而得到，是一长效β₂受体激动剂。沙丁胺醇（A错）也为β₂受体激动剂，但其分子中不含有亲脂性长链取代基。盐酸克仑特罗（B错）也是长效β₂受体激动剂，分子中不含有亲脂性长链取代基。盐酸多巴胺（C错）对β受体无选择性。盐酸多巴酚丁胺（E错）主要作用于β₁受体，分子中不含有亲脂性长链取代基，且半衰期较短。